下列关于唇的解剖层次描述哪一项是错误的
A. 最外层为皮肤，富于毛囊，皮脂腺和汗腺
B. 皮肤下为浅筋膜，较疏松
C. 中间为肌层，主要是口轮匝肌
D. 肌层内侧紧贴粘膜
E. 粘膜上有粘液腺开口

正确答案：D。肌层内侧紧贴粘膜

解析：唇的结构由外向内分为五层：①皮肤富于毛囊、皮脂腺和汗腺；②浅筋膜比较疏松；③肌层主要为口轮匝肌；④粘膜下层有粘液腺和上、下唇动脉；⑤粘膜有粘液腺开口。掌握“口腔境界及唇、颊的局部解剖”知识点。